银柴胡的功效是
A. 退虚热
B. 疏散风热
C. 疏肝解郁
D. 清利湿热
E. 升举阳气

正确答案：A。退虚热

解析：本题考查的是清虚热银柴胡的功效。银柴胡的功效是退虚热（A对）。银柴胡：【功效】退虚热，清疳热。连翘：【功效】清热解毒，疏散风热（B错），消肿散结，利尿。柴胡：【功效】解表退热，疏肝解郁（C错），升举阳气（E错）。芦根：【功效】清热生津，除烦止呕，利尿（D错）。